呈扁圆形或扁椭圆形；表面紫红色或紫褐色滑有光泽；有的一面较平坦，中间有1条隆起的纵线纹，另一面微隆起，边缘略薄的药材是
A. 酸枣仁
B. 补骨脂
C. 巴豆
D. 女贞子
E. 马钱子

正确答案：A。酸枣仁

解析：本题考查的是酸枣仁的性状鉴别。呈扁圆形或扁椭圆形；表面紫红色或紫褐色滑有光泽；有的一面较平坦，中间有1条隆起的纵线纹，另一面微隆起，边缘略薄的药材是酸枣仁（A对）。酸枣仁【性状鉴别】药材呈扁圆形或扁椭圆形。表面紫红色或紫褐色，平滑有光泽，有的有裂纹。有的两面均呈圆隆状突起；有的一面较平坦，中间有1条隆起的纵线纹，另一面微隆起，边缘略薄。一端凹陷，可见线形种脐，另一端有细小突起的合点。种皮较脆，胚乳白色，子叶2，浅黄色，富油性。气微，味淡。补骨脂（B错）【性状鉴别】药材呈肾形，略扁。表面黑色、黑褐色或灰褐色，具细微网状皱纹。顶端圆钝，有一小突起，凹侧有果梗痕。质硬。果皮薄，与种子不易分离；种子1枚，子叶2，黄白色，有油性。气香，味辛、微苦。巴豆（C错）【性状鉴别】药材呈卵圆形，一般具三棱。表面灰黄色或稍深，粗糙，有纵线6条，顶端平截，基部有果梗痕。破开果壳，可见3室，每室含种子1粒。种子呈略扁的椭圆形，表面棕色或灰棕色，一端有小点状的种脐及种阜的疤痕，另端有微凹的合点，其间有隆起的种脊；外种皮薄而脆，内种皮呈白色薄膜；种仁黄白色，油质。气微，味辛辣。女贞子（D错）【性状鉴别】药材呈卵形、椭圆形或肾形。表面黑紫色或灰黑色，皱缩不平。基部有果梗痕或具宿萼及短梗。体轻。外果皮薄，中果皮较松软，易剥离，内果皮木质，黄棕色，具纵棱，破开后种子通常为1粒，肾形，紫黑色，油性。气微，味甘、微苦涩。马钱子（E错）【性状鉴别】药材呈纽扣状圆板形，常一面隆起，一面稍凹下。表面密被灰棕色或灰绿色绢状茸毛，自中间向四周呈辐射状排列，有丝样光泽。边缘稍隆起，较厚，有突起的珠孔，底面中心有突起的圆点状种脐。质坚硬，平行剖面可见淡黄白色胚乳，角质状，子叶心形。气微，味极苦。